药品零售连锁企业从事质量管理、验收、养护及计量等工作的专职人员数量，不少于企业职工总数的
A. 0.01
B. 0.02
C. 0.03
D. 0.04
E. 0.05

正确答案：B。0.02